风湿性心脏病的发病机制主要与下列哪一项有关
A. 自身抗原的改变
B. 分子模拟
C. 表位扩展
D. 免疫忽视的打破
E. 免疫隔离部位抗原的释放

正确答案：B。分子模拟